孕妇现孕34周，那么，她的血容量比未孕时约平均增加
A. 1250ml
B. 1450ml
C. 1650ml
D. 1850ml
E. 1950ml

正确答案：B。1450ml

解析：血容量：于妊娠6～8周开始增加，至妊娠32～34周达高峰，增加40%～45%，平均增加1450ml，维持此水平直至分娩。血浆增加多于红细胞增加，出现血液稀释。掌握“妊娠生理”知识点。